反映测验工具可靠性和稳定性的是
A. 测验的效度
B. 测验的信度
C. 测验的样本
D. 测验的常模
E. 测验的概念

正确答案：B。测验的信度

解析：信度反映工具的可靠性和稳定性。掌握“信度、效度和常模”知识点。